IQ=[15（X-M）/S]+100称为
A. 比率智商
B. 离差智商
C. 百分位智商
D. 中位数智商
E. 人格智商

正确答案：B。离差智商

解析：比率智商由Terman提出，其公式如下：IQ = （MA/CA） xlOO（A错）。公式中，MA为心理年龄，是某一儿童在智力测验的成绩所达到的水平。CA为实际年龄，即该儿童在测验时的实际岁数。比率智商公式是建立在儿童的智力水平随着年龄增长而增长的线性关系的基础上。但实际上智力发展到一定年龄便停止发展，呈平台状态，老年人的智力水平有所下降。因此，Wechsler提出了离差智商公式，IQ = 100 + 15（x-m）A（B对）。公式中，m为该年龄阶段样本在智力测验的平均成绩，x为某受试者在智力测验的成绩，s为样本成绩的标准差。离差智商计算方法克服了比率智商计算方法受年龄限制的缺点，成为目前通用的IQ计算方法。